可引起严重皮肤反应，如史蒂文斯-约翰综合征（Stevens-Johnson综合征）或剥脱性皮炎的药物有
A. 别嘌醇
B. 卡马西平
C. 苯巴比妥
D. 复方磺胺甲噁唑
E. 阿司匹林

正确答案：A、B、C、D。别嘌醇；卡马西平；苯巴比妥；复方磺胺甲噁唑

解析：本题考查药物的不良反应。可引起严重皮肤反应，如史蒂文斯-约翰综合征（Stevens-Johnson综合征）或剥脱性皮炎的药物有：别嘌醇（A对）、卡马西平（B对）、苯巴比妥（C对）、复方磺胺甲噁唑（D对）。别嘌醇典型的不良反应有剥脱性皮炎、血小板计数减少、少尿、尿频、间质性肾炎；苯巴比妥为巴比妥类，可能导致过敏，严重者可能发生剥脱性皮疹和史蒂文斯-约翰逊综合征；卡马西平较不常见的有过敏反应或Stevens-Johnson综合征或中毒性皮肤反应；复方磺胺甲噁唑常见不良反应为过敏反应，严重者可出现渗出性的多形红斑，剥脱性皮炎，大疱表皮松解性的皮炎。阿司匹林（E错）不会引起皮肤反应。